主治脾虚肝郁，湿浊带下的方剂首选
A. 二妙散
B. 易黄汤
C. 完带汤
D. 参苓白术散
E. 龙胆泻肝汤

正确答案：C。完带汤

解析：主治脾虚肝郁，湿浊带下的方剂，当具备健脾、疏肝、祛湿、止带之功。完带汤中重用白术、山药为君，意在补脾、祛湿，使脾气健运，湿浊得消。臣以人参补中益气，以助君药补脾之力；苍术燥湿运脾，以增祛湿化浊之功；白芍柔肝理脾，使肝木达而脾土自强；车前子渗利水湿，令湿浊从小便分利。佐以陈皮理气燥湿，既可使君药补而不滞，又可行气以化湿；辛散之柴胡、芥穗，得白术则升发脾胃清阳，配白芍则疏肝解郁。使以甘草调药和中。诸药共奏补脾疏肝，化湿止带之功，以主治脾虚肝郁，湿浊带下（C对）。二妙散功用为清热燥湿，主治湿热下注证（A错）。易黄汤功用为补肾，清热，祛湿，止带，主治肾虚湿热带下（B错）。参苓白术散功用为益气健脾，渗湿止泻，主治脾虚湿盛证（D错）。龙胆泻肝汤功用为清泻肝胆实火，清利肝经湿热（E错）。